构成高危险人群易感性的生物学基础不包括
A. 年龄
B. 体重
C. 遗传因素
D. 性别

正确答案：B。体重

解析：本题考查构成高危险人群易感性的生物学基础。易受环境因素损害的那部分易感人群称为高危险人群。构成高危险人群易感性的生物学基础包括：①年龄（A对）；②性别（D对）；③遗传因素（C对）；④营养及膳食；⑤健康状况；⑥适应和耐受性等。体重（B错，为本题正确答案）不是构成高危险人群易感性的生物学基础。